有机磷中毒烟碱样症状是
A. 肌肉震颤至全身抽搐，呼吸肌麻痹
B. 头晕、共济失调、谵妄、昏迷
C. 瞳孔缩小、流涎、肺水肿
D. 癫痫样抽搐、瞳孔不等大
E. 瞳孔散大、血压升高、心律失常

正确答案：A。肌肉震颤至全身抽搐，呼吸肌麻痹

解析：有机磷中毒烟碱样症状症状表现为横纹肌神经肌肉接头处ACh蓄积过多，出现肌纤维震颤、全身肌强直性痉挛，也可出现肌力减退或瘫痪，呼吸肌麻痹引起呼吸衰竭或停止（A对）。交感神经节后纤维末梢释放儿茶酚胺，表现为血压升高和心律失常，但无瞳孔散大或不等大（DE错）；头晕、共济失调、谵妄、昏迷（B错）为有机磷中毒中枢神经系统症状；瞳孔缩小、流涎、肺水肿（C错）为有机磷中毒毒蕈碱样症状。